食品卫生标准包括感官、理化和微生物指标，下列指标中严重危害人体健康的是
A. 金黄色葡萄球菌肠毒素
B. 菌落总数
C. 大肠菌群
D. 有异味
E. 挥发性盐基氮

正确答案：A。金黄色葡萄球菌肠毒素